恒牙骨化开始的年龄是
A. 新生儿
B. 1岁
C. 2岁
D. 3岁
E. 4岁

正确答案：A。新生儿

解析：恒牙从新生儿期开始骨化，第三横臼齿在18～24月时已骨化（A对）。对比记忆：乳牙出生时已骨化，乳牙萌出4～10个月开始，恒牙萌出6岁开始。